国家对供水单位实行（）制度
A. 备案
B. 卫生许可
C. 卫生监督
D. 卫生审查
E. 三同时

正确答案：B。卫生许可